女，45岁。发现左侧颈外侧有一无痛性肿块，约2.5cm×2cm×1.5cm，无压痛，无活动。为明确诊断，最有价值的检查方法是
A. 鼻咽部喉镜检查
B. B超
C. 细针穿刺活检
D. ECT颈部扫描
E. 肿块切除病理检查

正确答案：E。肿块切除病理检查

解析：中年女性患者，左侧颈外侧无痛性肿块，无活动，首先应考虑恶性肿瘤。肿块切除病理检查（E对），采用病理形态学检查的方法检查所发生的病变，是明确诊断最有价值的方法。肿块位于颈外侧，鼻咽部喉镜检查（A错）显然无效。B超（B错）、ECT颈部扫描（D错）均是辅助检查，虽有助于诊断，但无法明确诊断。细针穿刺活检（C错）可帮助诊断，但存在一定的假阳性及假阴性。